患者眩晕日久，精神萎靡，腰膝酸软，少寐多梦，健忘，两目干涩，视力减退，遗精，泄泻，耳鸣，齿摇，舌红少苔，脉细数，其证候是
A. 肝阳上亢证
B. 气血亏虚证
C. 肾精不足证
D. 痰湿中阻证
E. 瘀血阻络证

正确答案：C。肾精不足证

解析：题中患者为眩晕。精髓不足，不能上充于脑，故眩晕，精神萎靡；腰为肾之府，肾虚则腰膝酸软；肾开窍于耳，在体为骨，肾虚故耳鸣，齿摇；肾虚则心肾不交，则少寐多梦，健忘；肾精不足，水不涵木则两目干涩，视力减退；精关不固则遗精；阴虚则生内热，故舌红少苔，脉细数。以上证候属于肾精不足证。（C对）。肝阳上亢证之眩晕的主要表现为眩晕，耳鸣，头目胀痛，口苦，失眠多梦，遇烦劳郁怒而加重，急躁易怒等（A错）。气血亏虚证之眩晕的主要表现为眩晕动则加剧，劳累即发，面色㿠白，神疲乏力，倦怠懒言，唇甲不华等（B错）。痰湿中阻证之眩晕的主要表现为眩晕，头重昏蒙，或伴视物旋转，胸闷恶心，呕吐痰涎，食少多寐等（D错）。瘀血阻络证之眩晕的主要表现为眩晕，头痛，兼见健忘，失眠，心悸，面唇紫暗，舌暗有瘀斑等（E错）。